生物心理社会医学模式认为
A. 心身是统一的
B. 心理对健康和疾病有能动作用
C. 心理因素、社会因素和生物因素都影响人体健康和疾病的发生
D. 在健康和疾病问题上应将人视为一个整体
E. 以上都是

正确答案：E。以上都是